过敏性紫癜风热伤络证的首选方剂是
A. 银翘散加减
B. 犀角地黄汤加减
C. 四妙散加味
D. 葛根黄芩黄连汤加味
E. 茜根散加减

正确答案：A。银翘散加减

解析：风热伤络起病较急，紫瘢以下肢和臀部为多，呈对称性，颜色鲜红，呈丘疹或红斑，大小形态不一，可融合成片，或有痒感，伴发热恶风，咳嗽咽痛，舌质红，苔薄黄，脉浮数。当运用银翘散疏风清热，凉血止血（A对）。紫癜血热妄行证，起病急骤，面赤咽干，皮肤瘀点瘀斑密集或成片，或伴关节肿痛，或伴腹痛，便血尿血，或有发热，大便干燥，舌质红绛，苔黄燥，脉弦数。宜用清热解毒，凉血化斑法治疗，方药采用犀角地黄汤加减（B错）。湿热痹阻症见皮肤紫癜多见于关节周围，尤以膝踝关节为主，关节肿胀灼痛，影响肢体活动，偶见腹痛、尿血，舌质红，苔黄腻，脉滑数或弦数。治疗采用四妙散，清热利湿，通络止痛（C错）。葛根黄芩黄连汤合小承气汤主治胃肠积热型紫癜，症见瘀斑遍布，下肢多见，腹痛阵做，口臭纳呆，腹胀便秘，苔黄，脉滑数（D错）。茜根散功效滋阴补肾，活血化瘀。主治肝肾阴虚型紫癜，症见紫癜起病缓慢，时发时隐，或紫癜已退，仍有腰背酸软，五心烦热，潮热盗汗等阴虚火旺症状（E错）。